关于咽鼓管的说法何者错误
A. 向后外借咽鼓管鼓室口与中耳鼓室相通
B. 向前内借咽鼓管咽口开口于鼻咽部的侧壁
C. 外2／3段为骨部，内1／3段为软骨部
D. 小儿咽鼓管比较短而平，故咽部感染易致中耳感染
E. 在吞咽、打哈欠时开放，以调节鼓室内、外的压力

正确答案：C。外2／3段为骨部，内1／3段为软骨部

解析：咽鼓管向后外借咽鼓管鼓室口与中耳鼓室相通(A对)，向前内侧由咽鼓管咽口开口于鼻咽部侧壁(B对)，外1/3段为骨部，内2/3为软骨部(C错，为本题正确答案)，幼儿的咽鼓管短而平，所以咽部的感染容易通过咽鼓管导致中耳感染(D对)，咽鼓管咽口在吞咽或打哈欠时开放，使空气进入鼓室，以调节鼓室内、外的压力(E对)。